某女，50岁。患白疕15年，症见皮疹为点滴状、基底鲜红色，表面覆有银白色鳞屑，证属血热风燥。皮肤科医师建议服用消银颗粒，此因该中成药除能祛风止痒外，还能
A. 补肺润燥
B. 温阳化湿
C. 养血润肤
D. 泻热润燥
E. 清热除湿

正确答案：C。养血润肤

解析：本题考查的是消银颗粒的功能。消银颗粒除能祛风止痒外，还能养血润肤（C对）。消银颗粒：【功能】清热凉血，养血润肤，祛风止痒。阳和解凝膏：【功能】温阳化湿（B错），消肿散结。地榆槐角丸：【功能】疏风凉血，泻热润燥（D错）。消风止痒颗粒：【功能】清热除湿（E错），消风止痒。功能为补肺润燥（A错）的中成药，2022年考试指南未明确说明。